具有磺胺类药物结构，作用于近曲小管的利尿药是
A. 螺内酯
B. 氢氯噻嗪
C. 吲达帕胺
D. 乙酰唑胺
E. 呋塞米

正确答案：D。乙酰唑胺

解析：本题考查乙酰唑胺的作用机制。具有磺胺类药物结构，作用于近曲小管的利尿药是乙酰唑胺（D对）。乙酰唑胺为碳酸酐酶抑制剂，作用于近曲小管上皮细胞，抑制细胞内碳酸酐酶，减少水的重吸收。氢氯噻嗪（B错）、吲达帕胺（C错）为噻嗪类利尿药，作用于远曲小管。呋塞米（E错）为袢利尿剂，作用于髓袢升支粗段。三者均有磺酰胺结构，故对磺胺类药物过敏者禁用。螺内酯（A错）为醛固酮受体阻断剂。